针灸治疗崩漏实证应选取
A. 三阴交足三里气海肾俞
B. 隐白血海阴陵泉关元
C. 三阴交肝俞气海
D. 关元隐白三阴交
E. 三阴交足三里气海

正确答案：D。关元隐白三阴交

解析：崩漏实证的主穴为关元、隐白、三阴交。关元属任脉，又与足三阴经交会，有通调冲任，固摄经血的作用；三阴交为足三阴经交会穴，可疏调足三阴之经气，以健脾益胃，调肝固肾，理气调血；隐白为足太阴经井穴，可健脾统血（D对）。足三里治疗虚劳；气海治疗气虚病；肾俞治疗肾虚病证（A错）。隐白、血海、阴陵泉治疗妇科病，关元治疗元气虚损病（B错）。肝俞治疗肝胆疾病；气海治疗气虚病（C错）。足三里治疗虚劳；气海治疗气虚病（E错）。